一级动力学消除的药—时曲线在半对数坐标图上则为
A. 曲线
B. 直线
C. 抛物线
D. 圆环
E. 点状

正确答案：B。直线

解析：一级动力学消除的药-时曲线在半对数坐标图上则为直线，呈指数衰减，故一级动力学过程也称线性动力学过程。掌握“药物消除及重要参数”知识点。